能收敛邪气，凡邪气未尽之证均当慎用的是
A. 酸味药
B. 咸味药
C. 辛味药
D. 淡味药
E. 甘味药

正确答案：A。酸味药

解析：本题考查的是五味对人体的效果。能收敛邪气，凡邪气未尽之证均当慎用的是酸味药（A对）。五味对人体的效果：（1）辛：辛味药（C错）大多能耗气伤阴，气虚阴亏者慎用。（2）甘：甘味药（E错）大多能腻膈碍胃，令人中满，凡湿阻、食积、中满气滞者慎用。（3）酸：酸味药大多能收敛邪气，凡邪未尽之证均当慎用。（4）苦：苦味药大多能伤津、伐胃，津液大伤及脾胃虚弱者不宜大量用。（5）咸：食盐类咸味药（B错）不宜多食，高血压动脉硬化者尤当如此。（6）涩：涩味药大多能敛邪，邪气未尽者慎用。（7）淡：淡味药（D错）过用，亦能伤津液，阴虚津亏者慎用。此外，还有芳香味。芳香味与辛味一样，亦能耗气伤津，气虚津亏者慎用。